隐性感染的发现主要是通过
A. 找到病原体
B. 发现体征
C. 特异性免疫检查
D. 病理检查
E. 生化检查

正确答案：C。特异性免疫检查

解析：隐性感染又称亚临床感染，是指病原体侵入人体后，仅诱导机体产生特异性免疫应答，而不引起或只引起轻微的组织损伤，因而在临床上不显出任何症状、体征甚至生化改变，只能通过免疫学检查才能发现（C对）。